某男，36岁。乙型肝炎病毒携带者，平时纳差乏力，大便不调。近期工作繁忙，加之饮酒过量，遂致面目悉黄、胸胁胀痛、恶心、小便黄赤，医师诊为湿热黄疸。宜选用的成药是
A. 茵栀黄口服液
B. 香连丸
C. 萆薢分清丸
D. 茵陈五苓丸
E. 消炎利胆片

正确答案：A。茵栀黄口服液

解析：本题考查的是茵栀黄口服液的主治。乙型肝炎病毒携带者，平时纳差乏力，大便不调。近期工作繁忙，加之饮酒过量，遂致面目悉黄、胸胁胀痛、恶心、小便黄赤，医师诊为湿热黄疸。宜选用的成药是茵栀黄口服液（A对）。茵栀黄口服液：【主治】肝胆湿热所致的黄疸，症见面目悉黄、胸胁胀痛、恶心呕吐、小便黄赤；急、慢性肝炎见上述证候者。香连丸（B错）：【主治】大肠湿热所致的痢疾，症见大便脓血、里急后重、发热腹痛；肠炎、细菌性痢疾见上述证候者。萆薢分清丸（C错）：【主治】肾不化气、清浊不分所致的白浊、小便频数。茵陈五苓丸（D错）：【主治】肝胆湿热、脾肺郁结所致的黄疸，症见身目发黄、脘腹胀满、小便不利。消炎利胆片（E错）：【主治】肝胆湿热所致的胁痛、口苦；急性胆囊炎、胆管炎见上述证候者。